女，34岁。48拔除后10小时，伤口疼痛明显，有张口受限。现体温37℃。最可能的情况是
A. 拔牙创急性感染
B. 术后反应性疼痛
C. 拔牙术后干槽症
D. 咽峡前间隙感染
E. 拔牙后全身感染

正确答案：A。拔牙创急性感染

解析：本题考查拔牙术后感染。女，34岁。48拔除后10小时，伤口疼痛明显，有张口受限。现体温37℃。最可能的情况是拔牙创急性感染（A对）。拔牙创急性感染常发生于下颌阻生智齿拔出后，易引起颌面部间隙感染，先有拔牙创疼痛明显、后有开口受限；术后反应性疼痛，无张口受限等症状（B错）；干槽症疼痛为3～5d后剧烈放射痛（C错）；咽峡前间隙感染属于拔牙创急性感染，主要症状是开口受限和吞咽疼痛（D错）；拔牙后10小时出现全身感染的可能性极小（E错）。